至适温度的研究旨在使哪些人感到舒适
A. 每个人
B. 绝大多数人
C. 50％以上的人
D. 70％以上的人
E. 80％以上的人

正确答案：B。绝大多数人